十二经脉气血充盛有余时，则渗注于
A. 孙络
B. 奇经
C. 别络
D. 浮络
E. 经别

正确答案：B。奇经

解析：奇经八脉具有蓄溢和调节十二经血的作用。当十二经脉气血有余时，则流入奇经八脉，蓄以备用；当十二经脉气血不足时，奇经中的气血及时溢出给予补充，以维持十二经脉中气血的相对恒定（B对）。浮络，是循行于人体浅表部位且常浮现的络脉。其分布广泛，没有定位，起着沟通经脉，输达肌表的作用（D错）。孙络，是最细小的络脉，属络脉的再分支，分布全身，难以计数，有"溢奇邪，通荣卫"的作用（A错）。十二经别的生理功能：①加强十二经脉表里两经在体内的联系。②加强体表与体内、四肢与躯干的向心性联系。③加强足三阴、足三阳经脉与心脏的联系。④加强了十二经脉和头面部的联系（E错）。⑤扩大十二经脉的主治范围。别络的生理功能（C错）：①加强十二经脉表里两经在体表的联系。②加强人体前、后、侧面联系，统率其他络脉。③渗灌气血以濡养全身。